由于伤病或死亡造成的工资损失，属于
A. 直接成本
B. 间接成本
C. 隐性成本
D. 固定成本
E. 机会成本

正确答案：B。间接成本